有关队列研究暴露人群的选择，下列各项错误的是
A. 职业人群
B. 特殊暴露人群
C. 一般人群
D. 有组织的人群团体
E. 患有某欲研究疾病的人群

正确答案：E。患有某欲研究疾病的人群

解析：本题考查队列研究暴露人群的选择。队列研究人群包括暴露组和对照组，暴露人群即暴露于待研究因素的人群，根据研究的方便与可能，通常有下列四种选择：职业人群（A对），特殊暴露人群（B对），一般人群（C对），有组织的人群团体（D对）。患有某欲研究疾病的人群（E错，为本题正确答案）不可以作为队列研究暴露人群的选择。